用青霉素治疗梅毒、钩端螺旋体病时能出现寒战、咽痛、心率加快等症状，其原因可能是大量病原体被杀灭后出现的全身性反应，这种反应称为
A. 瑞夷综合征
B. 青霉素脑病
C. 金鸡纳反应
D. 赫氏反应
E. Steven-Johnson综合征

正确答案：D。赫氏反应

解析：本题考查特征性反应。赫氏反应（D对）是应用青霉素治疗梅毒、钩端螺旋体病等疾病时，可由于病原体死亡而致症状加剧的反应。全身应用大剂量青霉素可引起青霉素脑病（B错）。病毒感染伴有发热的儿童和青少年服用阿司匹林后，偶见急性肝脂肪变性-脑病综合征（瑞夷综合征）（A错）。从金鸡纳树皮中提取的奎尼丁，长时间用药，出现头痛，头晕，耳鸣，腹泻，恶心，视力模糊等症状称为金鸡纳反应（C错）。Steven-Johnson综合征（E错）又称重症型多形性红斑，是由免疫复合物所致的一种过敏性疾病，主要表现为严重的多形性红斑。